医院污水是一类特殊的废水，为防止其危害健康，应进行特殊处理，与其他废水处理不同的是必须进行
A. 一级处理
B. 二级处理
C. 三级处理
D. 生物处理
E. 消毒处理

正确答案：E。消毒处理

解析：本题考查医院污水的消毒处理。医院污水是一类特殊的废水，为防止其危害健康，应进行特殊处理，与其他废水处理不同的是必须进行消毒处理（E对ABCD错）。